7个月患儿，发热3天，体温39～40℃，流涕，轻咳。查体：一般情况好，除咽部充血外，未见其他异常，家长一直服用中药治疗。近日热退，因皮肤出现红色斑丘疹而就诊。最可能的诊断是
A. 风疹
B. 水痘
C. 麻疹
D. 猩红热
E. 幼儿急疹

正确答案：E。幼儿急疹

解析：7个月患儿，发热3天，体温39～40℃，流涕，轻咳。查体：一般情况好，除咽部充血外，未见其他异常，近日热退而出现红色斑丘疹等符合幼儿急疹的全身症状表现，如：主要见于婴幼儿，一般情况好，耳后淋巴结可肿大等，且该患儿热退后伴皮疹出现符合幼儿急疹发热与皮疹的关系，故该患儿可能的诊断是幼儿急疹（E对）。而风疹（A错）全身症状轻，耳后、枕后淋巴结肿大并触痛，皮疹多在症状出现后1～2天出现，且有面颈部→躯干→四肢的先后顺序，故该患儿不考虑此病。水痘（P174）（B错）出疹前可有前驱症状，如发热、不适和厌食等。24～48小时出疹，皮疹常首发于头、面和躯干，继而扩展到四肢，呈向心性分布，故该患儿不考虑此病。麻疹（C错）的全身症状有发热、咳嗽、畏光、鼻卡他、结膜炎等，皮疹多在发热后3～4天出现，且出疹期为发热的高峰期，为红色斑丘疹，退疹后有色素沉着及细小脱屑，故该患儿不考虑此病。猩红热（D错）的全身症状除有发热、咽痛、头痛、呕吐、杨梅舌、环扣苍白圈、颈部淋巴结肿大外等，皮疹多在发热1～2天出现，且出疹时高热，皮肤弥漫性充血，疹退后伴脱皮，故该患儿不考虑此病。